下列哪一项不属于养生的原则
A. 顺应自然
B. 形神兼养
C. 调养脾肾
D. 因人而异
E. 饮食有节

正确答案：E。饮食有节

解析：饮食有节属于未病先防的预防措施，不属于养生原则（E错，为本题正确答案）。顺应自然，是中医养生学的重要原则。人以天地之气生，四时之法成。人生干天地之间，依赖于自然而生存，同时也受到自然规律的支配和制约，即人与天地相参，与日月相应（A对）；形神兼养，指形体与精神的协调统一，身心和谐的养生原则（B对）；调养脾胃，指利用各种手段和方法来调护保养脾胃，发挥脾升胃降协调、受纳运化相因、水谷精气充足、营养脏腑经络及四肢百骸的功能（C对）；形体锻炼、调摄饮食等养生方法均需要因人而异（D对）。